影响疟原虫叶酸代谢过程的抗疟药是
A. 奎宁
B. 青蒿素
C. 乙胺嘧啶
D. 伯氨喹
E. 氯喹

正确答案：C。乙胺嘧啶

解析：本题考查乙胺嘧啶。影响疟原虫叶酸代谢过程的抗疟药是乙胺嘧啶（C对）。乙胺嘧啶能抑制疟原虫的二氢叶酸还原酶，使其叶酸代谢受阻，从而影响疟原虫的核酸合成，使其生长繁殖受到抑制。奎宁（A错）是喹啉类衍生物，能与疟原虫的DNA结合，形成复合物抑制DNA的复制和RNA的转录，从而抑制原虫的蛋白合成，还能降低疟原虫氧耗量，抵制疟原虫内的磷酸化酶而干扰其糖代谢。青蒿素（B错）通过产生自由基，破坏疟原虫的生物膜、蛋白质等最终导致虫体死亡，具有高效、速效、低毒的特点。伯氨喹（D错）的抗疟机制可能与干扰DNA的合成有关，该药能抑制线粒体的氧化作用，使疟原虫摄氧量显著减少。氯喹（E错）抗疟作用机制复杂，与氯喹在疟原虫溶酶体内的高度浓集有关。①氯喹能与疟原虫DNA双螺旋链中的鸟嘌呤、胞嘧啶碱基对结合，形成氯喹-DNA复合物，抑制DNA的复制和转录，并使DNA断裂，抑制疟原虫的繁殖；②氯喹是弱碱性药物，容易大量进入疟原虫体内，使虫体细胞内的pH升高，形成对蛋白质分解酶不利的环境，使疟原虫分解和利用血红蛋白的能力降低，导致氨基酸缺乏而抑制疟原虫的生长繁殖；③红细胞内期裂殖体破坏红细胞后产生疟色素，其组分高铁原卟啉被认为是氯喹等抗疟药的高亲和性受体，与氯喹结合，可破坏疟原虫细胞膜，使疟原虫溶解。